可通过抗原非特异性方式杀伤病毒感染细胞的免疫细胞是
A. 中性粒细胞
B. T细胞
C. B细胞
D. 肥大细胞
E. NK细胞

正确答案：E。NK细胞

解析：非特异性免疫由固有免疫细胞产生，固有免疫细胞主要包括单核／巨噬细胞、中性粒细胞、树突状细胞、NK细胞、NKT细胞、γδT细胞、B1细胞、肥大细胞、嗜碱性粒细胞和嗜酸性粒细胞等。NK细胞（E对）不表达特异性抗原识别受体，以抗原非特异性方式杀伤某些肿瘤细胞和病毒感染细胞。中性粒细胞（A错）主要杀伤细菌感染细胞。T细胞（B错）和B细胞（C错）不是固有免疫细胞。肥大细胞（D错）与Ⅰ型超敏反应有关。